根尖最狭窄的地方在
A. 约距根尖孔1mm处
B. 约距根尖1mm处
C. 约距跟中1/3与根尖1/3交界处
D. 约距跟颈1/3与根中1/3交界处
E. 约在根管口处

正确答案：A。约距根尖孔1mm处

解析：本题考查根尖解剖特点。根尖最狭窄的地方在约距根尖孔1mm处（A对）。根尖最狭窄处通常位于牙本质牙骨质界处，称为组织学根尖孔，约距解剖性根尖孔1mm处（CD错），根尖孔一般不在根尖处（B错）。根管口（E错）为髓室底上髓室与根管的移行处，不是根尖最狭窄处。